男，22岁。上腹痛1日，次日转至右，伴恶心，无呕吐。查体：T38.5℃，双肺呼吸音清，未闻及干湿性啰音，心律齐，腹平软，右下腹明显压痛，反跳痛（+），未触及包块。血WBC15.6×10⁹/L.N0.86，尿沉渣镜检：RBC1-3/HP，WBC2-3/HP。最可能的诊断是
A. 急性胆囊炎
B. 右侧输尿管结石
C. 急性肠系膜淋巴结炎
D. 急性化脓性阑尾炎
E. 十二指肠溃疡急性穿孔

正确答案：D。急性化脓性阑尾炎

解析：男性患者，22岁，上腹痛1日，次日转移至右下腹，压痛反跳痛（+）为典型的急性阑尾炎体征（D对），体温38.5℃（高热），实验室检查血WBC15.6×10⁹/L，N0.86（中性粒细胞比例超过80%-90%），尿沉渣镜检：RBC1-3/HP，WBC2-3/HP（提示患者炎症蔓延到盆腔），以上实验室检查表明患者炎症较为严重，可诊断为急性化脓性阑尾炎。急性胆囊炎（A错）典型临床体征为右上腹阵发性绞痛，伴有Murphy征阳性。右侧输尿管结石（B错）表现为肾绞痛，通常在运动后或夜间突发一侧腰背部剧烈“刀割样”疼痛。急性肠系膜淋巴结炎（C错）多见于7岁以下儿童，体检脐部和右下腹均有压痛，且范围广泛，压痛点不固定。十二指肠溃疡急性穿孔（E错）临床体征表现为持续后背放射痛，板状腹，腹膜刺激征阳性。